卡介苗（BCG）适宜的接种对象主要是
A. 结核性脑膜炎患者
B. 结核菌素试验阳性者
C. 严重的结核病患者
D. 新生儿以及结核菌素试验阴性的儿童
E. 细胞免疫功能低下者

正确答案：D。新生儿以及结核菌素试验阴性的儿童

解析：本题考查卡介苗适宜的接种对象。新生儿和婴幼儿，由于该年龄小儿对结核菌的抵抗力特别低，一旦受感染易发展为急性严重结核病，以及未接种过卡介苗且结核菌素试验阴性（D对ABCE错）的儿童，应尽早接种卡介苗。活动性结核病患者及细胞免疫功能低下人群禁忌接种卡介苗，以免诱发结核病再燃或加重病情。